《中国药典》规定，药物中有机溶剂苯的残留量不得超过
A. 0.002
B. 0.0002
C. 2.0E-5
D. 2.0E-6
E. 2.0E-7

正确答案：D。2.0E-6